血红蛋白的正常值参考范围是
A. 男性80g/L～160g/L，女性70g/L～150g/L
B. 男性90g/L～160g/L，女性80g/L～150g/L
C. 男性100g/L～150g/L，女性90g/L～150g/L
D. 男性110g/L～160g/L，女性100g/L～150g/L
E. 男性120g/L～160g/L，女性110g/L～150g/L

正确答案：E。男性120g/L～160g/L，女性110g/L～150g/L

解析：本题考查血常规检查。血红蛋白的正常值参考范围是：男性120～160g/L，女性110～150g/L（E对），新生儿170～200g/L。